关于农村社区健康教育的基本内容包括
A. 农村常见疾病防治的宣传教育
B. 移风易俗，改变不良卫生习惯
C. 农村环境卫生与环境保护
D. 健康观念与卫生法制教育
E. 以上各项均是

正确答案：E。以上各项均是